某人研究新生儿缺氧缺血性脑病的病因，选择100例确诊的新生儿缺氧缺血性脑病病例和100例同期同医院出生的正常新生儿，对新生儿母亲孕期病史及分娩情况进行回顾性分析，分析与新生儿缺氧缺血性脑病相关的危险因素。这种研究方法是
A. 病例对照研究
B. 前瞻性研究
C. 临床随访研究
D. 实验研究
E. 现况调查研究

正确答案：A。病例对照研究

解析：本题考查病例对照研究的原理。病例对照研究的基本原理是以当前已经确诊的患有某特定疾病的一组病人作为病例组，以不患有该病但具有可比性的一组个体作为对照组。本题中100例确诊的新生儿缺氧缺血性脑病病例和100例同期同医院出生的正常新生儿分别为病例组和对照组，因此该研究为病例对照研究（A对BCDE错）。